某女，38岁。既患崩漏下血，又患赤白带下，适宜选用的药是
A. 芡实
B. 桑螵蛸
C. 金樱子
D. 海螵蛸
E. 蛇床子

正确答案：D。海螵蛸

解析：本题考查的是海螵蛸的主治病证。某女，38岁。既患崩漏下血，又患赤白带下，适宜选用的药是海螵蛸（D对）。海螵蛸：【主治病证】（1）崩漏下血，肺胃出血，创伤出血。（2）肾虚遗精，赤白带下。（3）胃痛吞酸。（4）湿疮湿疹，溃疡不敛。芡实（A错）：【主治病证】（1）脾虚久泻不止。（2）肾虚遗精，小便不禁，白带过多。桑螵蛸（B错）：【主治病证】（1）肾阳亏虚之遗精、滑精，遗尿、尿频，小便白浊，带下。（2）阳痿不育。金樱子：【主治病证】（1）遗精滑精，尿频遗尿。（2）久泻久痢。（3）崩漏带下。蛇床子（D错）：【主治病证】（1）阴部湿痒，湿疹，湿疮，疥癣。（2）寒湿带下，湿痹腰痛。（3）肾虚阳痿，宫冷不孕。